制备固体分散物的常用方法不包括
A. 溶剂法
B. 熔融法
C. 复凝聚法
D. 溶剂-熔融法
E. 溶剂-喷雾（冷冻）干燥法

正确答案：C。复凝聚法